男性，12岁，自幼喉结上有蚕豆大的肿块，近来有增大、肿痛，后肿物破溃，伤口肉芽肿状，一直流白色液体。其最可能的诊断应是
A. 淋巴结化脓性感染
B. 甲状腺峡部腺癌
C. 甲状舌管囊肿感染
D. 鳃裂囊肿感染
E. 舌下腺肿瘤

正确答案：C。甲状舌管囊肿感染

解析：颈部肿块临床上十分常见，需熟悉其鉴别诊断。从仅有的资料看，其特点有：幼时发生颈前部肿物，位于舌骨体以下，长期无症状，近来增大、有肿痛，说明发生了继发感染，经皮肤破溃、不愈合、流白色液体，应是先天性的甲状舌管囊肿，因其与舌根盲孔相通，唾液流入发生化脓性感染，前面仅为皮肤，极易烂穿，内容物似唾液样流出成为瘘管，经久不愈。可排除其他化脓性病灶，其位置可以排除鳃裂囊肿(位于颈侧面)、甲状腺峡部肿瘤(在甲状软骨以下)和舌下腺肿瘤(在口底)。一旦溃破成瘘，伤口便不能自愈，一直流唾液，十分不便，必须手术治疗。掌握“外科感染”知识点。